患者，男，58岁，有高血压、冠心病、血脂异常、便秘、骨关节炎和胃溃疡病史，2年前接受冠状动脉支架植入术。近日，患者先后在心内科、消化科、骨科就诊，开具药品如下：酒石酸美托洛尔片、阿司匹林肠溶片、单硝酸异山梨酯片、阿托伐他汀钙片、聚乙二醇4000散、双氯芬酸钠缓释片、奥美拉唑肠溶片、麝香保心丸和复方丹参片。关于该患者药物治疗方案的说法，错误的是
A. 美托洛尔会影响阿司匹林的抗血小板活性，应停用
B. 阿托伐他汀钙用于冠心病的治疗，需长期规律用药
C. 如大便次数规律（如每日1次），聚乙二醇4000散可按需使用
D. 同时使用双氯芬酸钠与阿司匹林会增加消化道出血风险，两药不宜合用
E. 麝香保心丸和复方丹参片均属活血类中成药，选用其中一种即可

正确答案：A。美托洛尔会影响阿司匹林的抗血小板活性，应停用

解析：本题考查药物相互作用。美托洛尔与阿司匹林合用，可用于冠心病的治疗（A错，为本题正确答案）。“ABCDE方案”对于指导冠心病二级预防有所帮助：“A”指阿司匹林和ACEI，“B”指β受体阻断剂和血压控制，“C”指控制胆固醇和戒烟，“D”指控制饮食和糖尿病，“E”指健康教育和运动。阿托伐他汀钙用于冠心病的治疗，需长期规律用药（B对）。聚乙二醇4000为渗透性泻药，在肠内形成高渗状态，吸收水分，增加粪便体积，刺激肠道蠕动，用于成人及8岁以上儿童（包括8岁）便秘。如大便次数规律（如每日1次），聚乙二醇4000散可按需使用（C对）。同时使用双氯芬酸钠与阿司匹林会增加消化道出血风险，两药不宜合用（D对）。麝香保心丸和复方丹参片均属活血剂，选用其中一种即可（E对）。